口腔种植学的指导理论是
A. 骨结合理论
B. 纤维结合理论
C. 骨牵张理论
D. 微创理论
E. 骨粘连理论

正确答案：A。骨结合理论

解析：本题考查口腔种植学的指导理论。口腔种植学的指导理论是骨结合理论（A对），所谓骨结合即指光镜下埋植在活骨的种植体与骨组织直接接触，其间不存在骨以外，如结缔组织等组织。如果形成纤维结合（B错）或骨粘连（E错），则不能保证种植体的长期疗效，视为失败。骨牵张理论是牵张成骨技术的理论基础（C错）。微创理论是口腔颌面外科手术的基本原则（D错）。